可激活补体的是
A. KIR2DL
B. NKp46
C. TCR
D. MBL
E. CEA

正确答案：D。MBL